下列关于非甾体抗炎药双氯芬酸说法错误的是
A. 是芳基乙酸类代表性药物，具有较强的抗炎作用
B. 主要代谢产物为苯环羟基化衍生物，无抗炎活性
C. 可通过抑制环氧合酶产生抗炎作用
D. 可通过抑制脂氧合酶产生抗炎作用
E. 可通过抑制花生四烯酸释放产生抗炎作用

正确答案：B。主要代谢产物为苯环羟基化衍生物，无抗炎活性

解析：本题考查双氯芬酸的作用机制和药理作用。双氯芬酸钠主要代谢产物为苯环羟基化衍生物，均有抗炎镇痛活性（B错，为本题正确答案），但活性均低于本品，经肾脏和胆汁排泄。